患者，男，70岁。小便点滴不通，短赤灼热，尿细如线，小腹胀满，口苦口粘，舌质红，苔黄腻，脉数。治疗应首选
A. 八正散
B. 沉香散
C. 春泽汤
D. 清肺饮
E. 石韦散

正确答案：A。八正散

解析：题中患者以小便点滴不通为主症，故诊断为癃闭，小便点滴不通，短赤灼热，尿细如线为湿热壅积膀胱所致，湿热互结，膀胱气化不利，故小腹胀满，湿热内盛，故口苦口粘，舌质红，苔黄腻，脉数为下焦湿热之象，故辨为膀胱湿热证，治宜清利湿热，通利小便，方选八正散（A对）。沉香散为癃闭肝郁气滞证的选方，亦可用于治疗气淋，功能疏肝达气，活血行水（B错）。春泽汤常合补中益气汤治疗癃闭脾气不升证，功能益气通阳利水（C错）。清肺饮为癃闭肺热壅盛证的选方，功能清肺泄热利水（D错）。石韦散为石淋的选方，功能清热利湿，排石通淋（E错）。